延伸卡环又称
A. 单臂卡环
B. 双臂卡环
C. 长臂卡环
D. 三臂卡环
E. 多臂卡环

正确答案：C。长臂卡环

解析：长臂卡环：又称延伸卡环，用于近缺隙基牙松动或外形无倒凹无法获得足够固位力者。掌握“局部义齿固位体”知识点。